呃逆的基本治法是
A. 理气化瘀降逆
B. 疏肝解郁降逆
C. 和胃降逆止呃
D. 健脾温中止呃
E. 清热和胃止呃

正确答案：C。和胃降逆止呃

解析：呃逆的发病是以气逆动膈为要点。胃居膈下，以降为顺，“动膈”即是指膈间气机不利，又为胃气之逆所触动，因此治疗呃逆的基本治法为降逆止呃（C对）。